下列属于条件反射的是
A. 闻到食物香味引起唾液分泌
B. 异物接触眼球引起眼睑闭合
C. 咀嚼、吞咽食物引起胃液分泌
D. 强光刺激视网膜引起瞳孔缩小
E. 叩击股四头肌腱引起小腿前伸

正确答案：A。闻到食物香味引起唾液分泌